目前国际上把预真空高压蒸汽灭菌器分3个等级其中N级指的是
A. 灭菌前没有抽真空
B. 灭菌前抽1次真空
C. 灭菌前抽2次真空
D. 灭菌前抽3次真空
E. 灭菌前抽4次真空

正确答案：A。灭菌前没有抽真空

解析：目前国际上把预真空高压蒸汽灭菌器分为3个等级，即N级：灭菌前没有抽真空；S级：灭菌前抽1次真空；B级：灭菌前抽3次真空。在灭菌前进行抽三次预真空可确保手机轴承的空隙及管道内的空气完全抽出，热空气方能进入其管道，从而杀灭管道内回吸的病原微生物和病毒。掌握“口腔器械的消毒与灭菌及医疗废物处理”知识点。